对于少年儿童来说，各种身体素质的最快发展阶段有一定的年龄特点。以下说法错误的是
A. 平衡能力训练在小学低年级即可进行
B. 柔韧性、反应速度等可从小学高年级开始系统训练
C. 速度训练的最佳时间是初中阶段
D. 专项耐力训练最好到初中阶段
E. 重力性训练最好到高中阶段

正确答案：D。专项耐力训练最好到初中阶段